热刺激的温度应高于
A. 20℃
B. 40℃
C. 30℃
D. 60℃
E. 50℃

正确答案：D。60℃

解析：本题考查牙髓温度测验。热刺激的温度应高于60℃（D对）。正常牙髓对20～50℃的温度刺激无明显不适反应（ABCE错），10～20℃的冷水和50～60℃的热水也很少引起疼痛感。